下列哪项与小肠通过经脉互为络属，构成表里关系
A. 肝
B. 心
C. 脾
D. 肺
E. 肾

正确答案：B。心

解析：心与小肠通过经脉相互属络构成了表里关系。（B对）。肝（A错）与胆通过经脉相互属络构成了表里关系。脾（C错）与胃通过经脉相互属络构成了表里关系。肺（D错）与大肠通过经脉的相互熟络构成了表里关系。肾（E错）与膀胱通过经脉相互属络构成了表里关系。